主要表现为皮肤梅毒疹的疾病是
A. 淋病
B. 一期梅毒
C. 二期梅毒
D. 三期梅毒
E. 尖锐湿疣

正确答案：C。二期梅毒

解析：主要表现为皮肤梅毒疹的疾病是二期梅毒（B对）。淋病（A错）主要导致泌尿生殖系统的化脓性感染，也可有眼、咽、直肠感染和播散性淋球菌感染。一期梅毒（B错）主要表现硬下疳、硬化性淋巴结炎。三期梅毒（D错）主要以梅毒性树胶肿为主要临床表现。尖锐湿疣（E错）皮损初起为单个或多个散在的淡红色小丘疹，质地柔软，顶端尖锐，后渐增多增大，依疣体形态可分为无柄型(即丘疹样皮损）和有柄型，后者可呈乳头状、菜花状、鸡冠状及蕈样状；疣体常呈白色、粉红色或污灰色，表面易发生糜烂，有渗液、浸渍及破溃，尚可合并出血及感染。